不属于嘌呤核苷酸从头合成直接原料的是
A. CO₂
B. 甘氨酸
C. 谷氨酸
D. 天冬氨酸
E. 一碳单位

正确答案：C。谷氨酸